诊断急性蛛网膜下腔出血准确率较高的是
A. MRI
B. 血管造影
C. 腰椎穿刺
D. X线检查
E. CT

正确答案：E。CT

解析：本题考查急性蛛网膜下腔出血的诊断。诊断急性蛛网膜下腔出血准确率较高的是CT（E对）。急性蛛网膜下腔出血为SAH。CT诊断急性SAH的准确率几乎达到100%，出血1周内其显示最清晰；MRI（A错）对发病1周内的急性SAH很难查出；已确诊的SAH不需再作腰椎穿刺，腰椎穿刺（C错）获取脑脊液化验检查在SAH伴有颅内压增高时可能诱发脑疝。另外脑血管造影（B错）只是确定SAH病因的一种检查手段。